某男，24岁。患感冒，症见恶寒、发热、无汗、头熏而痛，肢体酸痛，证属外感风寒夹湿，宜选用的成药是
A. 正柴胡饮颗粒
B. 午时茶颗粒
C. 银翘解毒颗粒
D. 桑菊感冒片
E. 九味羌活丸

正确答案：E。九味羌活丸

解析：本题考查的是九味羌活丸的主治。患感冒，症见恶寒、发热、无汗、头重而痛，肢体酸痛，证属外感风寒夹湿，宜选用的成药是九味羌活丸（E对）。九味羌活丸：【主治】外感风寒夹湿所致的感冒，症见恶寒、发热、无汗、头重而痛、肢体酸痛。正柴胡饮颗粒（A错）：【主治】外感风寒所致的感冒，症见发热恶寒、无汗、头痛、鼻塞、喷嚏、咽痒咳嗽、四肢酸痛；流感初起、轻度上呼吸道感染见上述证候者。午时茶颗粒（B错）：【主治】外感风寒，内伤食积证，症见恶寒发热、头痛身楚、胸脘满闷、恶心呕吐、腹痛腹泻。银翘解毒颗粒（C错）：【主治】风热感冒，症见发热、头痛、咳嗽、口干、咽喉疼痛。桑菊感冒片（D错）：【主治】风热感冒初起，头痛，咳嗽，口干，咽痛。